对于龋病的易感者可以进行的预防措施为
A. 垫底
B. 去腐充填
C. 药物治疗
D. 再矿化治疗
E. 牙髓治疗

正确答案：D。再矿化治疗

解析：再矿化治疗的适应证：光滑面的早期龋（白垩色斑块/褐斑）；龋易感者可作预防使用。掌握“龋病的治疗原则与非手术治疗方法”知识点。